某男，56岁。近日食欲减退，口淡无味，口中黏腻，唇干；舌淡有齿痕，脉沉缓。根据藏象理论，其病位主要在
A. 肺
B. 心
C. 脾
D. 肾
E. 肝

正确答案：C。脾

解析：本题考查脾与志、液、体、华、窍的关系。根据藏象理论，其病位主要在脾（C对）。脾与志、液、体、华、窍的关系：1.脾在志为思：思虑过度，影响气的正常运行，导致气滞与气结；导致脾胃呆滞，运化失常，消化吸收功能障碍，而出现脘腹胀闷、食欲不振、头目眩晕等症。2. 脾在液为涎：若脾胃不和，则往往可导致涎液分泌的急剧增加，出现口涎自出等现象。3.脾在体合肌肉，主四肢：若脾失健运，清阳不升，布散无力，则四肢的营养不足，可见四肢倦怠无力，甚则痿弱不用。4.脾在窍为口，其华在唇：（1）口，指口腔，是消化管的起端，食物由此下咽以至食道，具有咀嚼、初步消化，并参与吞咽等功能。脾开窍于口，说明脾运强健，则口味正常，食欲良好；脾失健运，则不仅可见食欲不振，还可见到口味异常，如口淡、口腻、口甜、口臭等。（2）唇，口唇。脾主运化，为气血生化之源，脾的运化功能强健与否，可反映于口唇。如脾运强健，口唇见色泽红润；脾运失健，口唇见萎黄不泽。肺（A错）与志、液、体、华、窍的关系：1.肺在志为忧（悲）；2.肺在液为涕；3.肺在体合皮，其华在毛；4.肺在窍为鼻，喉为肺之门户。心（B错）与志、液、体、华、窍的关系：1.心在志为喜2.心在液为汗3.心在体合脉，其华在面4.心在窍为舌。肾（D错）与志、液、体、华、窍的关系：1.肾在志为恐2.肾在液为唾3.肾在体合骨，其华在发4.肾在窍为耳及二阴。肝（E错）与志、液、体、华、窍的关系：1.肝在志为怒2.肝在液为泪3.肝在体合筋，其华在爪4.肝在窍为目。